眼球瞳孔的大小
A. 受中脑内的动眼神经核控制
B. 远视时瞳孔缩小
C. 瞳孔开大与副交感神经有关
D. 与睫状肌舒缩有关
E. 弱光时使瞳孔开大

正确答案：E。弱光时使瞳孔开大

解析：受中脑内的动眼神经核控制（A错）的是上、下、内直肌、下斜肌和上脸提肌的随意运动。远视时瞳孔开大，而非缩小（B错）；弱光时瞳孔开大（E对）。眼球瞳孔开大与交感神经有关，而非副交感神经（C错）。与睫状肌舒缩有关（D错）的是晶状体的曲度调节，而非眼球瞳孔的大小。